体表为阳，筋骨为
A. 阳中之阳
B. 阳中之阴
C. 阴中之阴
D. 阴中之阳
E. 阴

正确答案：B。阳中之阴

解析：由于阴阳之中复有阴阳，所以分属于阴阳的脏腑形体组织还可以再分阴阳。体表组织属阳，然皮肉为阳中之阳，筋骨为阳中之阴（B对）。